普萘洛尔治疗心绞痛无下列哪一作用
A. 心肌收缩力减弱
B. 心率减慢
C. 心脏舒张期相对延长
D. 心室容积增大，射血时间延长
E. 扩张血管

正确答案：E。扩张血管